男性，80岁。右腹股沟斜疝嵌顿2小时来诊，既往有可复性腹股沟斜疝史30年。检查：右侧腹股沟10cm×6cm嵌顿疝，张力较高，皮肤无红肿，首选的治疗方法是
A. 试行手法复位
B. 手术复位并行疝囊高位结扎
C. 手术复位并行加强腹股沟管前壁疝修补术
D. 手术复位并行无张力疝修补术
E. 手术复位并行加强腹股沟管后壁斜疝修补术

正确答案：A。试行手法复位

解析：老年男性患者，右侧腹股沟斜疝嵌顿2小时（嵌顿时间在3～4小时以内，可先试行手法复位），查体疝块张力较高，皮肤无红肿（提示嵌顿肠管尚未发生绞窄坏死），首选的治疗方法是试行手法复位（A对）。加强腹股沟管前壁（C错）、后壁的疝修补术（E错）和无张力疝修补术（D错）用于不宜行手法复位的患者。单纯疝囊高位结扎术（B错）主要用于一岁以上的幼儿和绞窄性疝的患者。